以下哪项不是食品安全风险评估的步骤
A. 危害识别
B. 危害特征描述
C. 暴露评估
D. 风险特征描述
E. 危害处理

正确答案：E。危害处理